女，34岁。孕24周，自觉无力。面色略苍白。实验室检查Hb80g/L，RBC2.8×10¹²/L该孕妇应开始进行胎儿健康状况评估的时间为
A. 孕20～24周
B. 孕36～38周
C. 孕40～42周
D. 孕26～28周
E. 孕32～34周

正确答案：E。孕32～34周

解析：该孕妇34岁，为高龄孕妇，有自觉无力、面色苍白症状，且实验室检查符合妊娠期贫血的诊断，为高危孕妇，故应自32-34周（E对）开始进行胎儿健康状况评估。